孕期优质蛋白质应占总蛋白的
A. 1
B. 1/2
C. 1/3
D. 3/4
E. 1/10

正确答案：C。1/3